关于噬菌体的叙述，下列哪项是错误的
A. 是侵袭微生物的病毒
B. 具有病毒的生物学性状
C. 大多数噬菌体呈蝌蚪形
D. 含有DNA和RNA两种核酸
E. 头部衣壳和尾部的化学组成是蛋白质

正确答案：D。含有DNA和RNA两种核酸

解析：大多数噬菌体呈蝌蚪形，其头部衣壳和尾部的化学组成是蛋白质且具有抗原性，头部衣壳内含有噬菌体的遗传物质即DNA或RNA，尾部有能识别宿主菌细胞表面的特殊受体，与噬菌体的吸附功能有关。掌握“噬菌体性状及分类”知识点。